麦冬与天冬皆为百合科植物的干燥块根，二者除均能润肠通便外，又均能
A. 益胃生津
B. 滋阴益肾
C. 养阴清肺
D. 补益精血
E. 清心除烦

正确答案：C。养阴清肺

解析：本题考查麦冬和天冬的功效。麦冬与天冬皆为百合科植物的干燥块根，二者除均能润肠通便外，又均能养阴清肺（C对）。麦冬、天冬，同为滋养清润之品，均入肺经，能养阴清肺、润肠通便，治阴虚燥咳、劳嗽咯血，以及津枯肠燥便秘。其中，麦冬性微寒，滋阴清热润燥之力较弱；又入心、胃经，善益胃生津（A错）、清心而除烦安神，治胃阴虚之口渴、心阴虚或心火旺之心烦不眠。天冬性寒，滋阴清热润燥力强，又入肾经滋阴降火，治顿咳痰黏、肾阴亏虚之骨蒸潮热、阴虚消渴等。桑椹、墨旱莲，均性寒而善滋阴益肾（B错），治肝肾亏虚之头晕目眩、须发早白。然，桑椹长于补阴生津而治津伤口渴；并能养血、润肠，治血虚失眠、肠燥便秘。墨旱莲善清热、凉血止血，又治阴虚或血热之出血证。何首乌、阿胶，均能补血，治血虚诸证。其中，何首乌经蒸制者性微温，功偏补益精血（D错），为滋补良药，善治血虚精亏诸证，尤宜精亏血虚之须发早白；阿胶甘平滋腻，功偏补血止血，又善治出血兼血虚者。此外，何首乌生用，还能解毒、截疟、润肠通便，治疮肿、瘰疬、久疟不止、肠燥便秘；阿胶还能滋阴润肺，治阴虚燥咳、虚劳喘咳。百合、麦冬，均味甘性微寒，功能润肺、清心，治肺燥咳嗽或劳嗽咯血、虚烦不眠。然，百合长于润肺止咳，治肺虚久咳；又能安神，治热病余热未清之虚烦不眠。麦冬长于清心除烦（E错），治心阴虚心火旺之心烦不眠；又能益胃生津、润肠通便，治胃阴虚口渴及肠燥便秘。